男，70岁。进行性排尿困难7年。夜尿3～4次，尿流变细、费力。经非那雄胺治疗症状改善不明显。B超检查示前列腺54mm×45mm×38mm，残余尿100ml，双肾无积水。最大尿流率8ml/s。心肺肝肾功能正常。下一步首选的治疗方案是
A. 耻骨上经膀胱前列腺切除术
B. 改用口服雌激素
C. 经尿道前列腺切除术
D. 加用α受体阻滞剂
E. 膀胱穿刺造瘘

正确答案：C。经尿道前列腺切除术

解析：老年男性患者，进行性排尿困难，尿流变细、费力（前列腺增生典型表现），B超检查示前列腺54mm×45mm×38mm（正常大小约为40mm×30mm×20mm，提示前列腺体积增大），结合患者的病史、临床表现和相关检查，应诊断为前列腺增生。患者经药物治疗后症状无明显改善，最大尿流率8ml/s表明梗阻较为严重，提示有手术指证。患者心肺肝肾功能正常，全身情况较好，故下一步首选的治疗方案是经尿道前列腺切除术（TURP）（C对），该术式适用于大多数良性前列腺增生病人，是目前最常用的手术方式。耻骨上经膀胱前列腺切除术（A错）仅用于巨大前列腺或合并有膀胱结石的患者。雌激素（B错）对患者心血管系统的副作用较大，故不宜应用。α受体阻滞剂主要用于前列腺增生体积较小、症状较轻的患者，该病人存在明显梗阻，非那雄胺治疗症状无明显改善，加用α受体阻滞剂（D错）对患者病情改善的意义不大。膀胱穿刺造瘘（E错）主要用于残余尿量较多或有肾积水、肾功能不全的前列腺增生患者的术前治疗。